A县张某系艾滋病患者，在B市传染病医院隔离治疗期间，擅自逃出医院回到A县，脱离隔离治疗。为防止艾滋病传播，可以协助传染病医院追回张某采取强制隔离治疗措施的是
A. 卫生行政部门
B. 疾病控制中心
C. 民政部门
D. 司法部门
E. 公安部门

正确答案：E。公安部门